既泻下冷积，又祛痰利咽的药是
A. 巴豆
B. 甘遂
C. 芫花
D. 红大戟
E. 牵牛子

正确答案：A。巴豆

解析：本题考查的是巴豆的功效。既泻下冷积，又祛痰利咽的药是巴豆（A对）。巴豆：【功效】泻下冷积，逐水退肿，祛痰利咽，蚀疮去腐。甘遂（B错）：【功效】泻水逐饮，消肿散结。芫花（C错）：【功效】泻水逐饮，祛痰止咳。外用杀虫疗疮。红大戟（D错）：【功效】泻水逐饮，消肿散结。牵牛子（E错）：【功效】泻下，逐水，去积，杀虫。